急性化脓性骨髓炎的主要感染来源
A. 医源性感染
B. 血源性感染
C. 腺源性感染
D. 牙源性感染
E. 损伤性感染

正确答案：D。牙源性感染

解析：本题考查急慢性化脓性颌骨骨髓炎。急性化脓性骨髓炎：多来自于牙源性感染（D对），常继发急性根尖周脓肿和根尖周肉芽肿或根尖周囊肿等慢性根尖病变，少数情况亦可由外伤后感染和血行感染（B错）引起。病原菌主要为金黄色葡萄球菌和链球菌。